手三阴经的循行走向是
A. 从胸走手
B. 从腹走手
C. 从手走头
D. 从头走足
E. 从足走腹

正确答案：A。从胸走手

解析：十二经脉的循行走向总的规律是：手三阴经从胸走手（A对），手三阳经从手走头（C错），足三阳经从头走足（D错），足三阴经从足走腹胸（BE错）。